上颌切牙拔除时不能选择的麻醉方法是
A. 唇侧浸润麻醉
B. 腭侧浸润麻醉
C. 眶下孔阻滞麻醉
D. 切牙孔阻滞麻醉
E. 腭大孔阻滞麻醉

正确答案：E。腭大孔阻滞麻醉

解析：上颌中切牙、侧切牙拔除时多选用唇、腭侧局部浸润麻醉，也可选择眶下孔和切牙孔等阻滞麻醉。掌握“颌面部常用局麻法及牙拔除的麻醉选择”知识点。